结构类型为异喹啉类生物碱的化合物是
A. 士的宁
B. 汉防己甲素
C. 马钱子碱
D. 苦参碱
E. 麻黄碱

正确答案：B。汉防己甲素

解析：本题考查的是异喹啉类生物碱的化合物。结构类型为异喹啉类生物碱的化合物是汉防己甲素（B对）。双苄基异喹啉类：为两个苄基异喹啉通过1～3个醚键相连接的一类生物碱。如存在于防己科北豆根中的主要酚性生物碱蝙蝠葛碱，汉防己中的汉防己甲素和汉防己乙素。士的宁（A错）和马钱子碱（C错）具有相似的结构骨架，属于吲哚类衍生物。它们的分子结构中均有两个氮原子，其中吲哚环上的氮原子呈内酰胺结构，几无碱性，另一个氮原子为叔胺状态，故它们只相当于一元碱，呈中等强度碱性。双稠哌啶类由两个哌啶环共用一个氮原子稠合而成的杂环，具喹诺里西啶的基本母核。主要分布于豆科、石松科和千屈菜科。如苦参中的苦参碱（D错）、氧化苦参碱，野决明中的金雀花碱等。麻黄生物碱分子中的氮原子均在侧链上，为有机胺类生物碱。麻黄碱（E错）和伪麻黄碱属仲胺衍生物。